粉尘对人体可有以下哪种作用
A. 致纤维化
B. 刺激
C. 中毒
D. 致敏
E. 以上都是

正确答案：E。以上都是